男，70岁。乏力、腰痛半个月。既往体健。查体：轻度贫血貌，第2～4腰椎局部压痛。实验室检查：Hb80g/L，WBC5.6×10⁹/L，Plt156×10⁹/L；血清总蛋白108g/L，白蛋白30g/L，血肌酐177umol/L；骨髓细胞学检查示骨髓中异常浆细胞占0.45；腰椎X线片示第2腰椎压缩性骨折。为进一步明确诊断，下一步最需做的检查是
A. 血清β₂微球蛋白测定
B. 尿本-周蛋白测定
C. 尿常规
D. 血清钙测定
E. 尿，血免疫球蛋白测定

正确答案：E。尿，血免疫球蛋白测定

解析：患者老年男性，乏力腰痛半个月，第2～4腰棘部压痛，腰椎X线示L₂压缩性骨折（多发性骨髓瘤常导致骨骼损害，引起骨痛，以腰骶部最多见）；轻度贫血貌，实验室检查：Hb80g/L（成年男性Hb正常值120～160g/L），提示贫血，WBC5.6×10⁹/L（正常4～10×10⁹/L），Plt156×10⁹/L（正常100～300×10⁹/L）；血清总蛋白108g/L（正常60～80g/L）增高，白蛋白30g/L（正常40～55g/L）降低，血肌酐177μmol/L（正常44～133μmol/L）增高；骨髓细胞学检查示骨髓中异常浆细胞占0.45（骨髓中浆细胞＞30%是诊断多发性骨髓瘤的主要指标），故患者诊断为多发性骨髓瘤可能性大，为明确诊断下一步应给予尿、血免疫球蛋白测定（E对）。血清β₂微球蛋白测定（A错）可用于评估肿瘤负荷和预后，但主要用于测定肾小管功能；尿本周蛋白测定（B错）阳性仅见于半数患者，不如尿、血免疫球蛋白测定敏感；尿常规（C错）可有蛋白尿，但无特异性；血清钙测定（D错）血钙升高，无特异性。